女孩，7岁。因浮肿尿少3～4天入院。体检：眼睑浮肿。尿检：蛋白+，红细胞++，血压140/100mmHg。可能诊断为
A. 急性肾炎
B. 尿路感染
C. 单纯性肾病
D. 肾炎性肾病
E. 急进性肾炎

正确答案：A。急性肾炎

解析：女孩，有血尿、蛋白尿（+）、水肿、血压增高，应诊断为急性肾炎（A对）。尿路感染的尿检会有大量的白细胞，不符合尿路感染的特征（B错）。肾病综合征的尿蛋白定性多在+++，而此患儿的的尿蛋白仅有（+），不能诊断为肾病综合征（CD错）。急进性肾炎很少见于儿童，一般表现为短时间内肾功能急剧下降，因此急进性肾炎不符合题意（E错）。